饮水消毒的主要目的是
A. 预防化学性中毒
B. 预防食物中毒
C. 防止肠道传染病的发生
D. 预防三致作用的发生
E. 保证水的感官性状良好

正确答案：C。防止肠道传染病的发生

解析：消毒是指杀死病原微生物、但不一定能杀死细菌芽孢的方法。饮水消毒属于预防性消毒，是指未发现传染源情况下，对可能被病原体污染的水进行消毒措施。外界病原体必须借助一定的物体（水、空气、食物等）才能进入易感宿主体内。所有的肠道传染病、某些寄生虫病以及个别的呼吸道传染病（如结核、白喉等）都可以通过污染食物进行传播。因而饮水消毒的主要目的是防止肠道传染病的发生（C对）。